表示气温和气湿综合作用的指标是
A. 黑球温度
B. 湿球温度
C. 有效温度
D. 校正温度
E. 校正有效温度

正确答案：B。湿球温度

解析：本题考查小气候的综合评价指标。表示气温和气湿综合作用的指标是湿球温度（B对D错）。黑球温度（A错）表示气温、热辐射和气流综合作用的结果。有效温度（C错）是在不同温度、湿度和风速的综合作用下，人体产生的冷热感觉指标。校正有效温度（E错）是在有效温度基础上，综合考虑热辐射对机体的影响，将干球温度（气温）改用黑球温度，所得的有效温度。